膈上平T12的裂孔是
A. 上腔静脉孔
B. 下腔静脉孔
C. 主动脉裂孔
D. 食管裂孔
E. 无

正确答案：C。主动脉裂孔

解析：膈上平T12的裂孔是主动脉裂孔（C对）。下腔静脉孔（B错）是在膈上平T8的裂孔。食管裂孔（D错）是在膈上平T10的裂孔。